内分泌系统的调节中枢是
A. 下丘脑
B. 腺垂体
C. 甲状腺
D. 肾上腺
E. 松果体

正确答案：A。下丘脑